某女性患者，45岁，体检结果显示：血压180/100mmHg，体重68Kg，身高160cm（BMI=26.6），甘油三酯4.5mmol/L，胆固醇5.1mmol/L。对该患者进行非药物饮食要注意严格控制
A. 高糖类食物摄入
B. 胆固醇和脂肪摄入
C. 胆固醇摄入
D. 总热能和脂肪摄入
E. 蛋白质摄入

正确答案：D。总热能和脂肪摄入

解析：患者体检结果显示：血压180/100mmHg（升高，正常值＜120/80mmHg，收缩压≥180mmHg和（或）舒张压≥110mmHg为3级高血压），体重68Kg，身高160cm（BMI=26.6）（BMI正常值18.5～23.9，24.0～27.9为超重），甘油三酯4.5mmol/L（正常值＜1.76mmol/L，＞2.27mmol/L为升高），胆固醇5.1mmol/L（正常值＜5.18mmol/L）。该患者超重、血脂异常，而体重增加是血压升高的重要危险因素，血脂异常是动脉粥样硬化最重要的危险因素，若非同日测量三次血压值收缩压≥140mmHg和（或）舒张压≥90mmHg可诊断高血压。根据心血管疾病和肥胖的营养防治原则，该患者要严格控制的是总热能和脂肪摄入（D对）。高糖类食物（A错）应少吃，并非严格控制。控制蛋白质摄入（E错）为肾脏疾病及肝脏疾病的肝性脑病各期的治疗膳食。